下列措施中，对防止结核性胸膜炎患者发生胸膜肥厚最重要的是
A. 口服糖皮质激素
B. 胸腔内注射糖皮质激素
C. 胸腔内注射抗结核药物
D. 胸腔内注射链激酶或尿激酶
E. 反复穿刺抽液

正确答案：E。反复穿刺抽液

解析：由于结核性胸膜炎胸腔积液蛋白含量高，容易引起胸膜粘连，因此对防止结核性胸膜炎患者发生胸膜肥厚最重要的是反复穿刺抽液（E对）。糖皮质激素的治疗一般疗效不肯定（AB错）。一般情况下，抽胸腔积液后，没必要胸腔内注入抗结核药（C错）。胸腔内注射链激酶或尿激酶一般是可以在抽胸腔积液后采取的治疗，但不是最重要的治疗方式（D错）。